登革热属于法定报告传染病中的
A. 甲类
B. 乙类
C. 丙类
D. A类
E. B类

正确答案：B。乙类

解析：本题考查乙类传染病。乙类（B对ACDE错）传染病共有26种：传染性非典型肺炎、艾滋病、病毒性肝炎、脊髓灰质炎、人感染高致病性禽流感、人感染H7N9禽流感、麻彦、流行性出血热（现称肾综合征出血热）、狂犬病、流行性乙型脑炎、登革热、炭疽、细菌性和阿米巴性痢疾、肺结核、伤寒和副伤寒、流行性脑脊髓膜炎、百日咳、白喉、新生儿破伤风、猩红热、布鲁菌病、淋病、梅毒、钩端螺旋体病、血吸虫病、疟疾。